抗精神病药物最常见的不良反应是
A. 视物模糊
B. 体位性低血压
C. 口干便秘
D. 粒细胞缺乏
E. 锥体外系反应

正确答案：E。锥体外系反应

解析：抗精神病药物常见的不良反应：1.椎体外系反应：是抗精神病药物最常见的不良反应（E对）；2.自主神经：①抗胆碱能的副作用：表现为口干、视力模糊、排尿困难和便秘等；②α肾上腺素能阻滞作用：表现为体位性低血压、反射性心动过速，体位性低血压在治疗的头几天最为常见，氯丙嗪肌内注射时最容易出现。视物模糊、体位性低血压、口干、便秘均为抗精神病药物的不良反应，但都不是最常见的抗精神病药物的不良反应（ABC错）。